不属于病毒复制周期的是
A. 吸附与穿入
B. 复制
C. 转录
D. 扩散
E. 翻译

正确答案：D。扩散

解析：从病毒吸附并进入宿主细胞开始，经过基因组复制，转录，翻译出相应的病毒蛋白质，最后释放出子代病毒，称为一个复制周期。人和动物病毒的复制周期主要包括吸附、穿入和脱壳、生物合成、组装释放病毒粒子（病毒体）四个步骤。掌握“病毒形态、结构、增殖及影响因素”知识点。